下列哪项不是阳水证的临床表现
A. 起病急，病程短
B. 水肿先从头面肿起
C. 上半身肿甚
D. 水肿皮薄光亮
E. 肢冷腰酸痛

正确答案：E。肢冷腰酸痛

解析：阳水证多见表、热、实证，故有起病急、病程短（A对）的特点，风为阳邪，其性轻扬，风水相搏，推波助澜，故水肿先从头面肿起（B对），自上而下，继及全身，上半身肿甚（C对），肿处皮肤绷紧光亮（D对），按之凹陷即起，兼有寒热表证。肢冷腰酸痛（E错，为本题正确答案）属于阴水的范畴。